牙髓和牙本质在胚胎发生上联系紧密，对外界刺激的应答有互联效应，称为
A. 牙本质牙骨质复合体
B. 牙周膜牙槽骨复合体
C. 牙釉质牙本质界
D. 牙髓牙本质复合体
E. 牙髓牙釉质复合体

正确答案：D。牙髓牙本质复合体

解析：本题考查龋病概述。牙髓和牙本质在胚胎发生上联系紧密，对外界刺激的应答有互联效应，可将其视为一个生物整体，故称为牙髓牙本质复合体（D对）。